患者，男，28岁，出现鼻塞、流涕、打喷嚏等症状。该患者从事塔吊操作工作，不宜使用的药物是
A. 肥大细胞膜稳定剂
B. 白三烯受体阻断剂
C. 第一代抗组胺药
D. 糖皮质激素
E. 鼻用抗组胺药

正确答案：C。第一代抗组胺药

解析：本题考查过敏性鼻炎的用药注意事项。该患者从事塔吊操作工作，不宜使用的药物是第一代口服抗组胺药（C错，为本题正确答案）。口服抗组胺药罕见发生心脏毒性作用，但应引起重视。第一代口服抗组胺药由于明显的中枢神经抑制和抗胆碱作用，以及对认知功能的潜在影响，限制了其临床应用，故不推荐儿童、老年人以及从事危险性职业（例如高空作业等）的特殊人群。肥大细胞膜稳定剂（A对）是过敏性鼻炎的二线治疗药物，临床酌情使用。白三烯受体阻断药（B对）是过敏性鼻炎的一线治疗药物，临床可用于过敏性鼻炎伴或不伴哮喘的治疗。糖皮质激素（D对）是过敏性鼻炎的一线治疗药物，其对过敏性鼻炎患者的所有鼻部症状（包括打喷嚏、流鼻涕、鼻痒和鼻塞）均有显著改善作用，是目前治疗过敏性鼻炎最有效的药物。鼻用抗组胺药（E对）是过敏性鼻炎的一线治疗药物，其疗效相当于或优于第二代口服抗组胺药，特别是对鼻塞症状的缓解。